不属于人体器官移植的伦理原则是
A. 病人健康利益至上原则
B. 唯一性原则
C. 禁止商业化原则
D. 知情同意原则
E. 社会公益原则

正确答案：E。社会公益原则

解析：我国人体器官移植的伦理准则：1)病人健康利益至上原则；2)唯一选择原则；3)自愿、无偿与禁止商业化原则；4)知情同意原则该原则；5)尊重和保护供者原则；6)保密原则；7)公正原则；8)伦理审查原则。E项为人类辅助生殖技术的伦理原则。掌握“人体器官移植伦理”知识点。